雄激素最适合治疗
A. 缺铁性贫血
B. 海洋性贫血
C. 慢性感染性贫血
D. 铁粒幼红细胞贫血
E. 再生障碍性贫血

正确答案：E。再生障碍性贫血

解析：由于再生障碍性贫血（AA）是由于骨髓造血功能障碍引起的贫血，且雄激素可刺激骨髓造血，故雄激素对AA有效（E对）。缺铁性贫血（P551）（A错）治疗原则为根除病因及补铁治疗。海洋性贫血（P565）（B错）无症状者无需治疗，重型或有溶血危象者常需输血或应用糖皮质激素，脾大者可考虑脾切除。慢性感染性贫血（C错）治疗为解除感染，贫血严重者可输血。铁粒幼红细胞贫血（D错）治疗可大剂量使用VitB6。